不属于中枢神经系统的结构是
A. 三叉神经节
B. 豆状核
C. 背侧丘脑
D. 外侧膝状体
E. 锥体

正确答案：A。三叉神经节

解析：三叉神经节（A错，为本题正确选项）为躯体内的感觉神经纤维，属于周围神经系统。